青霉素作用的细菌靶位是
A. 细胞质的质粒
B. 细胞质的核糖体
C. 细胞壁的聚糖骨架
D. 细胞壁的磷壁酸
E. 细胞壁的五肽交联体

正确答案：E。细胞壁的五肽交联体

解析：本题考查抗菌药物的作用机制。青霉素作用的细菌靶位是细胞壁的五肽交联体（E对）。β-内酰胺类抗生素主要抑制肽聚糖合成所需的转肽酶反应，可阻止肽聚糖链的交叉连接，使细菌无法形成坚韧的细胞壁。β-内酰胺类抗生素可与细胞膜上的青霉素结合蛋白共价结合。该蛋白质是青霉素作用的主要靶位。